以生牛（羊）乳为原料，加热到至少132℃并保持很短时间灭菌的是
A. 超高温灭菌乳
B. 奶油
C. 奶酪
D. 调制乳
E. 淡炼乳

正确答案：A。超高温灭菌乳

解析：本题考查超高温灭菌乳。超高温灭菌乳（A对BCDE错）是以生牛（羊）乳为原料，添加或不添加复原乳，在连续流动的状态下，加热到至少132℃并保持很短时间的灭菌，再经无菌灌装等工序制成的液体产品。